风邪致病具有发病急变化快的特点，主要与其哪种性质相关
A. 风为阳邪
B. 风性主动
C. 风性数变
D. 风性轻扬
E. 风性善行

正确答案：C。风性数变

解析：风邪致病具有发病急变化快的特点，说明风具有善变的特点，风为阳邪与题干不符（A错），轻扬开泄，易袭阳位也与题干不符（D错）；风性善行（E错）数变（C对）；风性主动（B错），风为百病之长，多为外邪致病的先导。